在无任何刺激的情况下，唾液的基础分泌为每分钟
A. 0.1ml
B. 0.2ml
C. 0.3ml
D. 0.4ml
E. 0.5ml

正确答案：E。0.5ml

解析：在无任何刺激的情况下，唾液的基础分泌为每分钟0.5ml。掌握“唾液的分泌和功能”知识点。